引起尖锐湿疣的病原体是
A. 人免疫缺陷病毒（HIV）
B. 人乳头瘤病毒（HPV）
C. EB病毒（EBV）
D. 水痘带状疱疹病毒（VZV）
E. 巨细胞病毒（CMV）

正确答案：B。人乳头瘤病毒（HPV）

解析：生殖器尖锐湿疣等，其中人乳头瘤病毒（HPV）-6、11、16、18、31、33等型别，与宫颈癌的发生密切相关。掌握“狂犬病、人乳头瘤病毒”知识点。